与精神意识思维活动关系最密切的是
A. 肺主治节的生理功能
B. 心主血脉的生理功能
C. 脾主运化的生理功能
D. 肝主疏泄的生理功能
E. 肾主藏精的生理功能

正确答案：B。心主血脉的生理功能

解析：心的生理功能有：①心主血脉：指心气推动血液运行于脉中，流注全身，循环不休，发挥营养和濡润作用。②心主神明：指心具有主宰五脏六腑、形体官窍等生命活动和意识、思维等精神活动的功能。心主血脉与主神明密切相关。血是神志活动的物质基础之一。而心主神明，又能驭气以调控心血的运行。病理状态下，两者也常相互影响。如心血不足，心神失养，可致心神失常，而见精神恍惚、心悸失眠等症；心神异常，亦可影响心主血脉功能。因而心主血脉的生理功能与精神意识思维活动关系最密切（B对）。肺主治节是指肺对气、血、津液的治理和调节作用，不涉及精神意识思维活动方面（A错）。脾主运化指脾具有将水谷化为精微，将精微物质吸收并转输全身的生理功能。包括运化谷食和运化水饮两个方面（C错）。肝主疏泄，指肝具有维持全身气机疏通畅达，通而不滞，散而不郁的生理功能，包括调畅精神情志、协调脾升胃降、促进胆汁泌泄、维持血液循行、维持津液输布、调节排精行经等方面（D错）。肾主藏精，指肾贮存、封藏精气以主司人体的生长发育、生殖的生理功能，包括主生长发育与生殖、为脏腑之本、主生髓化血、主抵御外邪等方面（E错）。